医学人道主义的核心内容中不包括哪一项
A. 尊重患者的生命
B. 尊重患者的人格与尊严
C. 尊重患者平等的医疗与健康权利
D. 注重对社会利益及人类健康利益的维护
E. 患者的法律地位

正确答案：E。患者的法律地位

解析：医学人道主义的核心内容：尊重患者生命（A对）、尊重患者的人格与尊严（B对）、尊重患者平等的医疗与健康权利（C对）、注重对社会利益及人类健康利益的维护（D对）、社会及患者对医院、医务人员利益和价值的尊重。患者的法律地位不属于医学人道主义的核心内容（E错，为本题正确答案）。